人工后牙的牙尖斜度过大会导致
A. 咀嚼效率降低
B. （牙合）力过大
C. （牙合）力过小
D. 侧向力过大
E. 早接触

正确答案：D。侧向力过大

解析：人工后牙的牙尖斜度过大会导致侧向力过大。无尖牙（牙合）面无高起的牙尖，仅有外展隙，食物溢出沟等。无尖牙可减小侧向力，使（牙合）力主要以垂直方向向牙槽嵴传导。可减少由侧向力造成的义齿不稳定，但咀嚼效能不如解剖式牙。根据牙槽嵴宽窄和高低来选择后牙的牙尖高低和颊舌径宽窄。牙槽嵴窄且低平者，选择半解剖式牙或非解剖式牙，并要减小颊舌径。牙槽嵴高而宽者，可选择解剖式牙尖的后牙。掌握“全口义齿排牙及蜡型试戴”知识点。